男性，35岁。右肾疼痛，尿常规红细胞充满视野，白细胞2-3个/HP，尿路平片可见右下段输尿管走行区高密度阴影0.6cm，IVU可见右输尿管下段结石，其上输尿管轻度扩张，右肾轻度积水。患者中西药物治疗和大量饮水活动后绞痛解除，突然出现尿流中断及排尿终末痛，原因是
A. 急性前列腺炎
B. 结石在输尿管间壁段
C. 结石到膀胱
D. 结石到尿道
E. 尿道炎

正确答案：C。结石到膀胱

解析：青年男性患者，诊断为右下段输尿管结石，结石体积较小，行保守治疗后绞痛缓解，突然出现尿流中断、排尿终末痛（膀胱结石的典型表现），提示结石进入膀胱（C对）。急性前列腺炎（A错）的典型表现为尿频、尿急、尿痛，一般不会出现尿流中断。结石在输尿管间壁段（B错）主要表现为尿频、尿急、尿痛的膀胱刺激症状。结石到尿道（D错）典型表现排尿困难、有痛性血尿。尿道炎（E错）主要表现为尿道刺痒、尿痛以及尿急、尿频等症状，尿道口多有分泌物排出。